治疗月经过多血热证，应首选
A. 举元煎
B. 大补元煎
C. 保阴煎
D. 固阴煎
E. 失笑散

正确答案：C。保阴煎

解析：保阴煎功效清热凉血，固冲止血，可用于治疗月经过多血热证（C对）。举元煎原方治疗气血下陷，血崩血脱，亡阳垂危等证，可治疗月经过多气虚证以补气摄血固冲（A错）。大补元煎功效滋阴降火，治伴有潮热盗汗，咳嗽咯血，阴虚火旺证（B错）。固阴煎功效补益肾气，固冲调经，治疗伴有腰膝酸软，头晕耳鸣，面色晦黯或有黯斑等肾气不足之征的月经先期（D错）。失笑散功效活血化瘀止血，用于月经过多血瘀证（E错）。